人的生长发育靠气的
A. 推动作用
B. 防御作用
C. 气化作用
D. 固摄作用
E. 中介作用

正确答案：A。推动作用

解析：气的推动作用指气的激发和推动功能，主要体现于：①激发和促进人体的生长发育与生殖功能（A对）；。②激发和促进各脏腑经络的生理功能；。③激发和促进精、血、津液的生成与运行；。④激发和兴奋精神活动。气的防御作用是指气有卫护机体、抗御邪气的作用（B错）；气化，指人体精、气、血、津液各自的代谢及其相互转化（C错）；气的固摄作用是指气对体内精、血、津液等物质具有防止其无故流失的作用（D错）；气的中介作用，主要指气能感应传导信息以维系机体整体联系的作用（E错）。